雌激素和孕激素协同作用是
A. 输尿管蠕动
B. 子宫颈黏液稀薄
C. 增生期子宫内膜
D. 子宫收缩
E. 乳房发育

正确答案：E。乳房发育

解析：孕激素在雌激素作用的基础上，进一步促使女性生殖器和乳房的发育（E对）。黄体酮可以促进输尿管的蠕动（A错）。雌激素使宫颈口松弛、扩张，宫颈黏液分泌增加，性状变稀薄（B错），富有弹性易拉成丝状。孕激素使增生期子宫内膜转化为分泌期内膜，为受精卵着床做准备（C错）。孕激素降低子宫平滑肌兴奋性及其对缩宫素的敏感性，抑制子宫收缩（D错），有利于胚胎及胎儿宫内生长发育。